属时行感冒者，宜选用的方剂是
A. 参苏饮
B. 清瘟败毒饮
C. 百合固金汤
D. 荆防败毒散
E. 银翘散

正确答案：B。清瘟败毒饮

解析：本题考查的是感冒的辨证论治。属时行感冒者，宜选用的方剂是清瘟败毒散（B对）。感冒是感受风邪或时行病毒，卫表失和而导致的常见外感疾病，临床表现以鼻塞、流涕、喷嚏、头痛、恶寒、发热、全身不适、脉浮等为特征。（一）风寒感冒：【方剂应用】基础方剂为荆防败毒散（D错）（荆芥、防风、前胡、柴胡、羌活、独活、川芎、茯苓、枳壳、桔梗、甘草）加减。（二）风热感冒：【方剂应用】基础方剂为银翘散（E错）（金银花、连翘、竹叶、荆芥、牛蒡子、薄荷、桔梗、淡豆豉、甘草）加减。（三）时行感冒：【方剂应用】基础方剂为清瘟败毒饮（石膏、生地、犀角、栀子、丹皮、黄连、桔梗、黄芩、知母、赤芍、玄参、连翘、竹叶、甘草）加减。（四）气虚感冒：【方剂应用】基础方剂为参苏饮（A错）（人参、苏叶、甘草、茯苓、葛根、前胡、半夏、枳壳、桔梗、陈皮、木香）加减。百合固金汤（C错）为咳嗽肺肾阴虚的中成药应用。咳嗽肺阴亏耗证：【方剂应用】基础方剂为沙参麦冬汤（沙参、玉竹、生甘草、冬桑叶、麦冬、生扁豆、天花粉）加减。【中成药应用】常用中成药有养阴清肺膏、百合固金丸、二冬膏。